制备包合物常用的材料是
A. 聚乙烯吡咯烷酮
B. 乙基纤维素
C. β-环糊精
D. 磷脂和胆固醇
E. 聚乳酸

正确答案：C。β-环糊精

解析：本题考查制备包合物的材料。制备包合物常用的材料是β-环糊精（C对）。β-环糊精是制备包合物的常用材料。包合物系指一种分子被全部或部分包合于另一种分子的空穴结内，形成的特殊的络合物。环糊精为一种水溶性的结构，为中空筒形的包合材料，常见有α、β、γ三种。环糊精包合物是药剂学中广泛应用的新技术。聚乙烯吡咯烷酮（A错）为常用的亲水性凝胶骨架材料。乙基纤维素（B错）为不溶于水或水溶性极小的高分子聚合物，可作为不溶性骨架材料。脂质体由磷脂和胆固醇（D错）组成，含有脂质双层包围水相的内囊泡结构。聚乳酸（E错）不是制备包合物常用的材料。